采用病例对照研究方法对在某食堂就餐者中发生细菌性痢疾暴发的危险因素进行调查分析，其最大优越性在于该研究方法适用于
A. 罕见疾病的研究
B. 罕见暴露的研究
C. 常见疾病的研究
D. 因果关联的确证性研究
E. 病因的广泛探索

正确答案：E。病因的广泛探索

解析：本题考查病例对照研究的用途。病例对照研究最常被用于疾病病因或危险因素的研究，可以广泛探索病因（E对ABCD错）或危险因素，也可在描述性研究或探索性病例对照研究初步形成病因假说的基础上检验某个或某几个病因假说。